公共场所位置的选择，除按城市建设部门的统一规划外，还应考虑许多方面，除了
A. 合理的服务半径
B. 环境安静优雅
C. 交通便利
D. 是否影响周围居民的生活
E. 该地常年主导风向的上风侧

正确答案：E。该地常年主导风向的上风侧

解析：本题考查公共场所位置的选择。公共场所位置的选择，除按城市建设部门的统一规划外，还应考虑要有合理的服务半径（A对）、地势高而不潮湿、环境安静优雅（B对）、周围无较大污染源、交通便利（C对），同时，还要根据公共场所的性质考虑是否影响周围居民的生活（D对）。公共场所位置的选择与该地常年主导风向（E错，为本题正确答案）无关。